患儿周围血常规检查：MCV：79fl/dl，MCHC：30%，HGB：90g/L，PLT：150×10⁹/L，WBC：9×10⁹/L，其诊断是
A. 营养性缺铁性贫血
B. 血小板减少性紫癜
C. 营养性巨幼红细胞性贫血
D. 再生障碍性贫血
E. 混合性贫血

正确答案：A。营养性缺铁性贫血

解析：本题患儿MCV：79fl<80fI，MCHC：30%<31%，HGB：90g/L小于参考值低限，PLT：150×10⁹/L正常，WBC：9×10⁹/L正常可诊断为营养性缺铁性贫血（A对）；血小板减少性紫癜PLT<100×10⁹/L（B错）；营养性巨幼红细胞性贫血MCV>94fl/dl，32%<MCHC<38%（C错）；再生障碍性贫血80fl/dl<MCV<94fl/dl，32%<MCHC<38%（D错）；混合性贫血的血红蛋白显著减少，多在80g/L以下，网织红细胞正常或轻度减少。重症者白细胞可减少，血小板也轻度减少，外周血红细胞大小差别悬殊，小红细胞较正常小，大红细胞较正常大，小儿贫血的典型表现为大红细胞而低色素性改变，中心淡染区扩大，有明显中空现象（E错）。